腰椎间盘突出症最常见的部位是
A. T12～L1
B. L1～2
C. L2～3
D. L3～4
E. L4～5

正确答案：E。L4～5

解析：腰椎间盘突出症最常见的部位是腰4、5及腰5、骶1间隙（E对），约占全部椎间盘突出的95%。